检查某药物中的砷盐，称取样品2.0g，依法检查，与标准砷溶液2.Oml（l㎍As/ml）在相同条件下制成的砷斑比较，不得更深。砷盐的限量是
A. 百万分之一
B. 百万分之二
C. 百万分之十
D. 0.0001
E. 0.001

正确答案：A。百万分之一